过量服用含马钱子的中成药会引起
A. 面部肌肉紧张，痉挛，角弓反张，惊厥
B. 四肢抽搐，牙关紧闭，心律失常
C. 大汗，头昏目眩，口唇黏膜糜烂，脱发
D. 吐血，咯血，便血，尿血，黄疸
E. 口腔黏膜充血，牙齿肿胀溃疡，少尿

正确答案：A。面部肌肉紧张，痉挛，角弓反张，惊厥

解析：本题考查的是马钱子及含马钱子的中成药的中毒表现。过量服用含马钱子的中成药会引起面部肌肉紧张，痉挛，角弓反张，惊厥（A对）。马钱子及含马钱子的中成药的中毒表现：初期出现头晕、头痛、烦躁不安、面部肌肉紧张、吞咽困难；进而伸肌与屈肌同时做极度收缩，发生典型的士的宁惊厥、痉挛，甚至角弓反张，可因呼吸肌痉挛窒息或心力衰竭而死亡。四肢抽搐，牙关紧闭，心律失常（B错）为乌头类药物的中毒表现。乌头类药物的中毒表现：1.神经系统：表现为口舌、四肢及全身麻木，头痛，头晕，精神恍惚，语言不清或小便失禁，继而四肢抽搐、牙关紧闭、呼吸衰竭等。2.循环系统：表现为心悸气短、心律失常、血压下降、面色苍白、口唇发绀、四肢厥冷等。3.消化系统：表现为流涎、恶心、呕吐、腹痛、腹泻、肠鸣音亢进。吐血，咯血，便血，尿血，黄疸（D错）为雄黄及含雄黄的中成药的中毒表现。雄黄及含雄黄的中成药的中毒表现：1.消化系统表现为口腔咽喉干痛、烧灼感，口中有金属味，流涎，剧烈恶心呕吐、腹痛腹泻，严重时类似霍乱。2.各种出血症状，如吐血、咯血、眼结膜充血、鼻衄、便血、尿血等。3.肝肾功能损害而引起转氨酶升高、黄疸、血尿、蛋白尿等。4.严重者因心力衰竭、呼吸衰竭而死亡。5.长期接触可引起皮肤过敏，出现丘疹、疱疹、痤疮样皮疹等。口腔黏膜充血，牙齿肿胀溃疡，少尿（E错）为含朱砂、轻粉、红粉的中成药的中毒表现。含朱砂、轻粉、红粉的中成药的中毒表现：1.消化系统表现为恶心呕吐、腹痛腹泻、口中有金属味、流涎、口腔黏膜充血、牙龈肿胀溃烂等。2.泌尿系统表现为少尿、蛋白尿，严重者可发生急性肾功能衰竭。3.神经系统及精神方面症状。中毒表现为大汗，头昏目眩，口唇黏膜糜烂，脱发（C错）为的中药，2022年考试指南未明确说明。